根据《2016年兴奋剂目录》，具有促进蛋白质合成和减少氨基酸分解特征的合成类固醇属于
A. 蛋白同化制剂
B. 刺激剂
C. 血液兴奋剂
D. 肽类激素

正确答案：A。蛋白同化制剂

解析：本题考查兴奋剂分类。根据《2016年兴奋剂目录》，具有促进蛋白质合成和减少氨基酸分解特征的合成类固醇属于蛋白同化制剂（A对）。蛋白同化制剂（合成类固醇）：蛋白同化制剂又称同化激素，俗称合成类固醇，是合成代谢类药物，具有促进蛋白质合成和减少氨基酸分解的特征，可促进肌肉增生，提高动作力度和增强男性的性特征。滥用这类药物会导致人生理、心理的不良后果，还会形成强烈的心理依赖。作为兴奋剂使用的蛋白同化制剂（合成类固醇），其衍生物和商品剂型品种特别繁多，多数为雄性激素的衍生物。这是目前使用范围最广，使用频度最高的一类兴奋剂，也是药检中的重要对象。国际奥委会只是禁用了一些主要品种，但其禁用谱一直在不断扩大。刺激剂（B错）：刺激剂是最早使用，也是最早禁用的一批兴奋剂，也是最原始意义上的兴奋剂，因为只有这一类兴奋剂对神经肌肉的药理作用才是真正的“兴奋作用”。这类药物按药理学特点和化学结构可分为以下几种：①精神刺激药：包括苯丙胺和它的相关衍生物及其盐类。②拟交感神经胺类药物：这是一类仿内源性儿茶酚胺的肾上腺素和去甲肾上腺素作用的物质，以麻黄碱和它们的衍生物及其盐类为代表。③咖啡因类：此类又称为黄嘌呤类，因其带有黄嘌呤基团。④杂类中枢神经刺激物质：如尼可刹米、胺苯唑和士的宁等。血液兴奋剂（C错）：又称为血液红细胞回输技术，1988年汉城奥运会正式被国际奥委会列入禁用范围。肽类激素（D错）及类似物：这类物质大多以激素的形式存在于人体。肽类激素的作用是通过刺激肾上腺皮质生长、红细胞生成等实现促进人体的生长、发育，大量摄入会降低自身内分泌水平，损害身体健康，还可能引起心血管疾病、糖尿病等。滥用肽类激素也会形成较强的心理依赖。肽类激素包括：①人生长激素（HGH）及其类似物；②红细胞生成素（EPO）及其类似物；③胰岛素、胰岛素样生长因子及其类似物；④促性腺激素；⑤促皮质素类。